关于药品贮藏有关规定的说法，错误的是
A. 遮光是指贮藏时避免日光直射
B. 阴凉处是指贮藏温度不超过20℃
C. 凉暗处是指遮光且贮藏温度不超过20℃
D. 常温是指贮藏温度为10℃～30℃
E. 冷处是指贮藏温度为2℃～10℃

正确答案：A。遮光是指贮藏时避免日光直射

解析：本题考查的是有关贮藏条件的规定。遮光系指用不透光的容器包装，例如棕色容器或黑色包装材料包裹的无色透明、半透明容器（A错，为本题正确答案）。《中华人民共和国药典》简称《中国药典》，是国家监督管理药品质量的法定技术标准。在《中国药典》“凡例”中，对中药［贮藏］项下的各名词术语进行了详细的解释。［贮藏］项下的规定，系对药品贮藏与保管的基本要求，除矿物药应置干燥洁净处不作具体规定外，一般以下列名词术语表示。（1）遮光：系指用不透光的容器包装，例如棕色容器或黑色包装材料包裹的无色透明、半透明容器。（2）密闭：系指将容器密闭，以防止尘土及异物进入。（3）密封：系指将容器密封，以防止风化、吸潮、挥发或异物进入。（4）熔封或严封：系指将容器熔封或用适宜的材料严封，以防止空气和水分的侵入并防止污染。（5）阴凉处：系指不超过20℃（B对）的环境。（6）凉暗处：系指避光并不超过20℃（C对）的环境。（7）冷处：系指2～10℃（E对）的环境。（8）常温：系指10～30℃（D对）的环境。除另有规定外，［贮藏］项未规定贮存温度的一般系指常温。